队列研究中所有队列成员，必须具备
A. 暴露于同样的因素
B. 具有相同的病史
C. 只有相同的职业
D. 具有类似的特征

正确答案：D。具有类似的特征

解析：本题考查队列研究。队列研究是将人群按是否暴露于某可疑因素及其暴露程度分为不同组，追踪其各组的结局，比较不同组之间结局频率的差异，从而判定暴露因素与结局之间有无因果关联及关联大小的一种观察性研究方法。队列研究中所有队列成员，必须具有类似的特征（D对ABC错），才能满足被观察群体之间的可比性。